体现尊重原则的是
A. 杜绝对病人的有意伤害
B. 选择受益最大、损伤最小的治疗方案
C. 患者及家属无法实行知情同意时医生可以行使家长权
D. 对病人一视同仁
E. 合理筛选肾脏移植受术者

正确答案：C。患者及家属无法实行知情同意时医生可以行使家长权

解析：尊重原则是指医务人员要尊重病人及其做出的理性决定。当患者或家属的自主选择与他人或社会的利益发生冲突时，医生既要履行对他人、社会的责任，也要使患者的损失降低到最低。掌握“医学伦理的基本原则”知识点。